某男，70岁。患咳喘20余年。刻下动则气喘，自汗乏力、时发心悸、多梦、口渴，舌质淡红少苔。证属肺肾不足、心神失养，宜选用的药是
A. 五味子
B. 天冬
C. 浮小麦
D. 山茱萸
E. 薏苡仁

正确答案：A。五味子

解析：本题考查的是五味子的主治病证。患咳喘20余年。刻下动则气喘，自汗乏力、时发心悸、多梦、口渴，舌质淡红少苔。证属肺肾不足、心神失养，宜选用的药是五味子（A对）。五味子：【主治病证】（1）肺虚久咳或肺肾不足之咳喘。（2）津伤口渴，消渴。（3）表虚自汗，阴虚盗汗。（4）肾虚遗精、滑精。（5）脾肾两虚之五更泄泻。（6）虚烦心悸，失眠多梦。天冬（B错）：【主治病证】（1）肺热燥咳，顿咳痰黏，劳嗽咯血。（2）骨蒸潮热，津伤口渴，阴虚消渴。（3）肠燥便秘。浮小麦（C错）：【主治病证】（1）气虚自汗，阴虚盗汗。（2）骨蒸劳热。山茱萸（D错）：【主治病证】（1）肝肾亏虚之头晕目眩、腰膝酸软、阳痿。（2）肾虚之遗精、滑精，小便不禁，虚汗不止。（3）妇女崩漏及月经过多。薏苡仁（E错）：【主治病证】（1）小便不利、水肿、脚气肿痛。（2）脾虚泄泻。（3）湿温病邪在气分。（4）湿痹筋脉拘挛。（5）肺痈，肠痈。